男性患者，13岁，因自觉牙列不齐来就诊，查，上颌双侧恒尖牙唇侧异位萌出，造成恒尖牙异位萌出的原因是
A. 上颌双侧乳中切牙早失
B. 上颌双侧乳侧切牙早失
C. 上颌双侧乳尖牙早失
D. 上颌双侧第一乳磨牙早失
E. 上颌双侧第二乳磨牙早失

正确答案：C。上颌双侧乳尖牙早失

解析：在乳牙列中，乳尖牙常常受到侧切牙的萌出的压迫而造成牙根吸收而早失，间隙极易变小甚至消失，致使恒尖牙错位萌出。掌握“乳牙早失及间隙管理”知识点。